实脾散的功用是
A. 健脾和胃，消食止泻
B. 益气健脾，渗湿止泻
C. 健脾和胃，消痞除满
D. 温阳健脾，行气利水
E. 燥湿运脾，行气和胃

正确答案：D。温阳健脾，行气利水

解析：实脾散所治之证，是谓阴水，因脾肾阳虚，阳不化水，水气内停所致。治以温阳健脾，行气利水（D对）。趣记：实脾散，二佛煮老姜，瓜果破皮香。二佛（茯苓、附子）术老姜，瓜果朴皮香。